呈现圆脸、厚背、躯干发胖而四肢消瘦的“向心性肥胖”的特殊体形，提示
A. 甲状腺激素分泌过多
B. 生长素分泌过多
C. 肾上腺糖皮质激素分泌过多
D. 肾上腺素分泌过多
E. 胰岛素分泌不足

正确答案：C。肾上腺糖皮质激素分泌过多